可用正丁醇提取，且属于三萜类化合物的是
A. 白花前胡甲素
B. 莨菪碱
C. 苦杏仁苷
D. 柴胡皂苷a
E. 芦丁

正确答案：D。柴胡皂苷a

解析：本题考查的是柴胡皂苷的化学结构类型及其性质。可用正丁醇提取，且属于三萜类化合物的是柴胡皂苷a（D对）。柴胡中含有的总皂苷为1.6%～3.8%。柴胡中所含皂苷均为三萜皂苷，柴胡皂苷是柴胡的主要有效成分。《中国药典》以柴胡皂苷a和柴胡皂苷d为指标成分对柴胡药材进行含量测定。要求两者的总含量不少于0.30%。皂苷的溶解度：大多数皂苷极性较大，易溶于水、热甲醇和乙醇等极性较大的溶剂，难溶于丙酮、乙醚等有机溶剂。皂苷在含水正丁醇中有较大的溶解度，因此正丁醇常作为提取皂苷的溶剂。次级苷由于糖数目的减少极性降低，在水中溶解度减少，易溶于乙醇、丙酮、乙酸乙酯等。皂苷元则难溶于水而易溶于石油醚、苯、乙醚、三氯甲烷等低极性溶剂。皂苷有助溶性能，可促进其他成分在水中的溶解。白花前胡甲素（A错）为前胡的主要化学成分，属于香豆素。香豆素及其苷类化合物先溶解于热稀苛性碱的水溶液中，酸化后沉淀析出，借以和杂质分离从而达到提取和精制的目的。莨菪碱（B错）为洋金花的主要化学成分，属于生物碱。一些生物碱类在用酸性水从药材中提出后，加碱调至碱性即可从水中沉淀析出称为酸提碱沉法（酸／碱法）。苦杏仁苷（C错）为苦杏仁的主要化学成分，属于氰苷。苦杏仁苷易溶于水和醇，而几乎不溶于乙醚。根据此性质可采用萃取法提取苦杏仁苷。芦丁（E错）为槐花的主要化学成分，属于黄酮苷类化合物。提取时采用氢氧化钙提取，加酸中和使其沉淀出来达到分离的目的。